某男，65岁。宿有喘病，气短，动则喘甚，小便清长，腰酸痛，大便艰涩，排出困难。宜选用的药是
A. 桃仁
B. 苦杏仁
C. 郁李仁
D. 核桃仁
E. 冬瓜仁

正确答案：D。核桃仁

解析：本题考查的是核桃仁的主治病证。宿有喘病，气短，动则喘甚，小便清长，腰酸痛，大便艰涩，排出困难。宜选用的药是核桃仁（D对）。核桃仁：【主治病证】（1）肾虚之腰痛脚弱，阳痿遗精。（2）肺肾两虚之咳喘。（3）肠燥便秘。桃仁（A错）：【主治病证】（1）血滞闭经、痛经，产后腹痛，癥瘕，跌打肿痛。（2）肺痈，肠痈。（3）肠燥便秘。（4）咳喘。苦杏仁（B错）：【主治病证】（1）咳嗽气喘。（2）肠燥便秘。郁李仁（C错）：【主治病证】（1）肠燥便秘。（2）水肿腹满，脚气浮肿。冬瓜仁（E错）的主治病证，2022年考试指南未明确说明。